既能活血定痛,又能敛疮生肌的药物是
A. 三七
B. 茜草
C. 红花
D. 血竭
E. 桃仁

正确答案：D。血竭

解析：血竭的功效是活血定痛，化瘀止血，敛疮生肌（D对）。三七的功效是化瘀止血，活血定痛（A错）。茜草的功效是凉血化瘀止血，通经（B错）。红花的功效是活血通经，祛瘀止痛（C错）。桃仁的功效是活血祛瘀，润肠通便，止咳平喘（E错）。